下列哪种粉尘粒子的特点与它在空气中“浮游时间的长短”无关
A. 粒子分散度小的
B. 爆炸性大的
C. 荷电性大的
D. 形状圆的
E. 硬度大的

正确答案：B。爆炸性大的

解析：本题考查影响粉尘粒子漂浮时间的因素。粒子分散度越小（A对）、荷电性越强（C对）、硬度越大（E对）的粒子，在空气中漂浮的时间越短；形状圆（D对）的粒子，在空中漂浮的时间越长。而粒子的爆炸性（B错，为本题正确答案）与粉尘粒子的漂浮能力无关。